手太阳小肠经主治
A. 侧头、耳病、胁肋病
B. 前头、口齿、咽喉、胃肠病
C. 心病、胃病
D. 头、项、耳、目、咽喉病、热病、神志病
E. 肾病、肺病、咽喉病

正确答案：D。头、项、耳、目、咽喉病、热病、神志病

解析：手太阳小肠经主治头痛，目翳，咽喉肿痛等头面五官病；昏迷，发热，疟疾等热病神志病；经脉循行部位的其他病证包括项背强痛，腰背痛，手指及肘臂挛痛等（D对）。